男性，42岁，患重型急性胰腺炎，并发休克36h，经抗休克治疗后行胰腺和其周围坏死组织清除、腹腔引流术。术后心率106次/分，血压12.8/8kPa（96/60mmHg），中心静脉压0.98kPa（10cmH2O），呼吸22次/分，动脉血氧分压11.5kPa（66mmHg）,尿量每小时少于20ml，尿比重1.002。考虑病人已发生
A. 心功能不全
B. 肺功能衰竭
C. 肾功能衰竭
D. 血容量不足
E. 体内抗利尿激素分泌过多

正确答案：C。肾功能衰竭

解析：因为此患者急性胰腺炎并发休克，尿量低于25ml/h，所以可以判断此患者出现了急性肾衰竭。掌握“休克”知识点。